女，25岁。葡萄胎清宫术后13个月，阴道流血2周。妇科检查：阴道口处见一直径2cm紫蓝色结节，子宫稍大，质软，双侧附件正常。胸部X线片未见异常。尿妊娠试验（＋）。阴道病灶组织病理检查见成对高度增生滋养细胞，无绒毛结构，最有可能的诊断
A. 绒毛膜癌
B. 子宫内膜异位症
C. 葡萄胎
D. 侵蚀性葡萄胎
E. 阴道癌

正确答案：A。绒毛膜癌

解析：患者为年轻女性，葡萄胎清宫术后13个月，阴道流血2周（妊娠滋养细胞肿瘤在葡萄胎排空、流产或足月产后，有持续的不规则阴道流血，量多少不定），妇科检查：阴道口处见一直径2cm紫蓝色结节（发生阴道转移时，转移灶常位于引道前壁及穹窿，呈紫蓝色结节），子宫稍大，质软（常在葡萄胎排空后4～6周子宫尚未恢复到正常大小，质地偏软），双侧附件正常。胸部X线片未见异常。尿妊娠试验（﹢）。阴道病灶组织病理检查见成对高度增生滋养细胞，无绒毛结构（组织学检查时若仅见成片滋养细胞浸润及坏死出血，未见绒毛结构者，则诊断为绒癌），最有可能的诊断是绒毛膜癌（A对）。侵蚀性葡萄胎（D错）可在子宫肌层内或子宫外转移灶组织中若见到绒毛或退化的绒毛阴影。葡萄胎（P335）（C错）病理表现为水泡状物大小不一，镜下可见绒毛水肿，弥漫滋养细胞增生，种植部位滋养细胞呈弥漫性和显著性的异型性，无阴道转移症状。子宫内膜异位症（P271）（B错）的主要临床表现为继发性痛经、进行性加重、不孕，双合诊检查时，可发现子宫后倾固定，一侧或双侧附件处触及囊实性包块，活动差，尿妊娠试验阴性，无阴道转移症状。阴道癌（E错）较少见，病理类型以非角化大细胞癌多见，组织学检查无高度增生滋养细胞。